下列有关可摘局部义齿小连接体说法正确的是
A. 它与大连接体应呈锐角
B. 小连接体平行越过龈缘并缓冲
C. 位于牙齿邻间隙内的倒凹区
D. 将卡环、支托、基托等与大连接体相连接
E. 小连接体要有足够的柔软度

正确答案：D。将卡环、支托、基托等与大连接体相连接

解析：小连接体：小连接体的作用是把金属支架上的各部件，如卡环、支托、基托等与大连接体相连接。它与大连接体应呈直角、圆钝相连。小连接体垂直越过龈缘并缓冲。小连接体要有足够的硬度，位于牙齿邻间隙内的非倒凹区，避免影响义齿就位。掌握“局部义齿连接体”知识点。